1g葡萄糖可提供的热量是
A. 1kcal
B. 2kcal
C. 3kcal
D. 4kcal
E. 9kcal

正确答案：D。4kcal

解析：本题考查葡萄糖提供的热量。1g葡萄糖提供4kcal（D对）热量，1g脂肪提供9kcal热量，1g蛋白质提供4kcal热量。